下列哪一项属于口腔白斑的病理表现
A. 有非典型细胞
B. 基底细胞空泡样变性
C. 粒层不明显
D. 棘层松解
E. 上皮增生

正确答案：E。上皮增生

解析：本题考查口腔白斑、红斑病。白斑主要表现为上皮增生（E对），有过度正角化或过度不全角化，或两者同时出现为混合角化。上皮单纯性增生是良性病变，除上皮过度角化外还有粒层明显（C错）和棘层增生（D错），没有非典型细胞（A错）。上皮钉突虽伸长且变粗，但仍整齐，基底膜清晰（B错）。固有层和黏膜下层有淋巴细胞、浆细胞浸润。